三角肌的作用
A. 内收肩关节
B. 外旋肘关节
C. 外展肩关节
D. 伸肘关节
E. 无

正确答案：C。外展肩关节

解析：三角肌的作用是外展肩关节（C对），而非内收肩关节（A错），与肘关节无关（BD错）。